描述某指标随另一连续型变量变化的速度，宜绘制
A. 圆图
B. 直方图
C. 散点图
D. 复式条图
E. 半对数线图

正确答案：E。半对数线图